女，28岁。心悸3天。约2周前曾咳嗽、流涕。查体：心界不大，心率96次/分，可闻及早搏10次/分。心脏各瓣膜听诊区未闻及杂音和附加音。心电图示频发室性期前收缩。血清肌钙蛋白升高。该患者最可能的诊断是
A. 病毒性心肌炎
B. 感染性心内膜炎
C. 急性心肌梗死
D. 心绞痛
E. 风湿性心脏病

正确答案：A。病毒性心肌炎

解析：成年女性患者，发病前1～3周有病毒感染前驱症状，有心悸症状。心脏各瓣膜听诊区未闻及杂音和附加音。有心律失常，心电图示频发室性期前收缩。血清肌钙蛋白升高。综合患者的症状、体征和辅助检查，该患者最可能的诊断是病毒性心肌炎（A对）。感染性心内膜炎（B错）常有瓣膜病病史，且有发热，一般可闻及可变杂音。急性心肌梗死（C错）、心绞痛（D错）主要表现为突然发作剧烈而持久的胸骨后或心前区压榨性疼痛。风湿性心脏病（E错）主要表现为心慌气短、乏力、水肿、粉红色泡沫痰等症状。